女性，35岁。慢性肝炎病史3年，妇科检查宫颈糜烂Ⅲ°，子宫正常大小，要求避孕，应选择
A. 长效避孕药
B. 短效避孕药
C. 避孕套
D. 宫内节育器
E. 安全期避孕

正确答案：D。宫内节育器

解析：患者35岁，处于生育后期，此期避孕原则为：选择长效、安全、可靠的避孕方法，减少非意愿妊娠进行手术带来的痛苦。各种避孕方法（宫内节育器、皮下埋植剂、复方口服避孕药、避孕针、阴茎套等）均适用，根据个人身体状况进行选择。对某种避孕方法有禁忌证者，则不宜使用此种方法。患者有慢性肝炎病史，为甾体激素避孕药的禁忌证，不宜选用短效避孕药（B错）、长效避孕药（A错）。且患者妇检有宫颈糜烂Ⅲ°，有研究表明，避孕套与宫颈糜烂的发生有关，还可加重其发展，故不宜选用避孕套（C错）。安全期避孕法（E错）又称自然避孕法，并不十分可靠，不宜推广。故该患者用选择宫内节育器（D对）避孕。